者胸部平片阴影密度级别（+、++、+++、++++）间是否不同，可选择
A. 线性回归
B. 成组设计比较的轶和检验
C. 直线相关
D. 两样本t检验
E. 四格表X²检验

正确答案：B。成组设计比较的轶和检验

解析：二、三期矽肺患者胸部平片阴影密度级别（+、++、+++、++++）间是否不同属于推断多组有序资料的总体分布位置有无差别，即成组设计比较的秩和检验（B对）。线性回归（A错）可以用一个直线方程来描述两个变量间依存变化的数量关系，即自变量X变化时，因变量Y也相应的发生变化。对两变量关系的研究，有时并不要求由X估计Y，而关心的是两变量之间是否具有直线相关关系（C错）。两样本t检验（D错）适用于完全随机设计的两样本均数的比较，其目的是检验两样本所来自总体的均数是否相等。四格表X²检验（E错）用于推断两个总体率之间有无差别，四格表资料只有两行两列，四个基本数据。